下列关于交界痣的临床特点叙述中，不正确的是
A. 一般较小
B. 平坦或稍高于皮表
C. 痣无毛
D. 一般为淡棕色或深棕色
E. 自觉症状较明显

正确答案：E。自觉症状较明显

解析：交界痣为淡棕色或深棕色斑疹、丘疹或结节，一般较小，表面光滑、无毛，平坦或稍高于皮表。一般不出现自觉症状。掌握“色素痣”知识点。